慢性毒性试验设有四个计量组（高、中、低、最低）及对照组，哪个计量组为最大无作用剂量
A. 高计量组出现了明显的中毒症状，与对照组相比P<0.01
B. 中计量组出现了轻微中毒的症状,与对照相比P<0.05
C. 低计量组出现了个别动物极轻微中毒症状,与对照组相比P>0.05
D. 最低计量无任何中毒症状,与对照组相比P>0.05

正确答案：D。最低计量无任何中毒症状,与对照组相比P>0.05

解析：本题考查最大无用剂量的概念。最大无作用剂量是指不引起实验动物出现任何有害作用的最大剂量（D对ABC错）。